氢氯噻嗪抑制甲苯磺丁脲的促胰岛素释放作用，此为
A. 作用于同一作用点或受体的相互作用
B. 作用于不同作用点或受体的相互作用
C. 敏感化现象
D. 竞争性拮抗作用
E. 非竞争性拮抗作用

正确答案：D。竞争性拮抗作用

解析：本题考查药物的相互作用。竞争性拮抗作用（D对）是两种药物在同一作用部位或受体上发生拮抗作用。甲苯磺丁脲与氢氯噻嗪的作用靶点均为胰岛β细胞，故甲苯磺丁脲的降糖作用被氢氯噻嗪所拮抗属于竞争性拮抗作用。敏感化作用（C错）是指一种药物可使组织或受体对另一种药物的敏感性增强。非竞争性拮抗作用（E错）发生在不同作用部位或受体。